易耗伤人体津液的邪气是
A. 火
B. 寒
C. 暑
D. 湿
E. 燥

正确答案：E。燥